女，36岁，急起双下肢无力4天，双上肢无力2天，伴吞咽困难1天。病前1周有感冒病史。检查：双上肢肌力3级，双下肢肌力2级，肌张力低。腱反射消失，未引出病理征，颈4平面以下感觉消失，尿潴留。目前该患者应特别注意
A. 血压下降
B. 呼吸困难
C. 神志障碍
D. 脉搏加快
E. 瞳孔改变

正确答案：B。呼吸困难